患者，男，65岁，因发现左耳下肿物2年入院，患者两年前发现耳下肿物，时消时长，无疼痛、麻木，检查：左耳垂后下区有一直径3cm椭圆状肿物，质较软，活动度好，边界清楚，放射性核素显像显示肿物呈⁹⁹mTc凝集。对明确肿物性质，指导手术最有价值的检查是
A. 术前活检
B. 术中冰冻切片
C. MRI
D. 超声检查
E. 核素扫描

正确答案：B。术中冰冻切片

解析：本题考查沃辛瘤的诊断检查。患者，男，65岁，因发现左耳下肿物2年入院，患者两年前发现耳下肿物，时消时长，无疼痛、麻木，检查：左耳垂后下区有一直径3cm椭圆状肿物，质较软，活动度好，边界清楚，放射性核素显像显示肿物呈⁹⁹mTc凝集，应考虑为沃辛瘤。对明确肿物性质，指导手术最有价值的检查是术中冰冻切片（B对），因对于腮腺肿物，一般不作切取活检（A错），以免扩散，术中冰冻切片可确定其性质，MRI（C错）、超声检查（D错）、放射性核素扫描（E错）对诊断仅能提供参考，不能确诊。